男性，35岁。双下肢水肿2周，查体：血压130/80mmHg，双下肢轻度凹陷。尿常规：蛋白（+++），红细胞（++），Crl221umol/L，血浆白蛋白28g/L。若肾活检示肾小球系膜轻度增生，系膜区可见免疫复合物沉积，最可能的诊断是
A. 系膜增生性肾小球肾炎
B. 系膜毛细血管性肾小球肾炎
C. 微小病变性肾病
D. 局灶节段性肾小球硬化
E. 膜性肾病

正确答案：A。系膜增生性肾小球肾炎

解析：患者初步诊断为肾病综合征，进一步进行肾活检，发现肾小球系膜轻度增生，系膜区可见免疫复合物沉积，最可能的诊断是系膜增生性肾小球肾炎（A对）。系膜毛细血管性肾小球肾炎（B错）光镜下较常见的病理改变为系膜细胞和系膜基质弥漫重度增生，毛细血管袢呈“双轨征”。微小病变性肾病（C错）光镜下肾小球基本正常，近曲小管上皮细胞可见脂肪变性。局灶节段性肾小球硬化（D错）光镜下可见病灶呈局灶、节段分布，电镜下可见肾小球上皮细胞足突广泛融合、基底膜塌陷，系膜基质增多，电子致密物沉积。膜性肾病（E错）光镜下可见肾小球弥漫性病变，电镜下早期可见GBM上皮侧有排列整齐的电子致密物，常伴有广泛足突融合。